男性，30岁。由于深龋引起急性根尖周炎在某院开髓治疗后，仍有剧烈疼痛，而且面部开始肿胀。检查见髓腔开放，开髓孔大，根管内无腐屑和渗出物，叩（+++），龈轻红肿，已服消炎药。分析原因最可能是
A. 开髓孔过小
B. 根管不通畅
C. 有其他感染源
D. 抗感染力不强
E. 根尖孔不通畅

正确答案：E。根尖孔不通畅

解析：本题考查急性根尖周炎的应急处理。男性，由于深龋引起急性根尖周炎在某院开髓治疗后，仍有剧烈疼痛，而且面部开始肿胀（脓液聚集）。检查见髓腔开放，开髓孔大（A错），根管内无腐屑和渗出物（B错），叩（+++），龈轻红肿（处于急性根尖周脓肿阶段），已服消炎药（D错），综合考虑根尖孔不通畅（E对），使根尖部脓液聚集，达不到引流是最可能的原因。急性根尖周炎的应急处理是在局麻下开髓，疏通根尖孔，建立引流通道，使根尖渗出物及脓液通过根管得到引流，以缓解根尖部的压力，解除疼痛。该病例未提示有其他感染源的可能（C错）。